以下检测器中，可在气相色谱仪中使用的是
A. 示差折光检测器
B. 火焰离子化检测器
C. 荧光检测器
D. 光二极管阵列检测器
E. 蒸发光散射检测器

正确答案：B。火焰离子化检测器

解析：本题考查气相色谱仪的检测器。适合气相色谱法使用的检测器有：火焰离子化检测器（A对）（FID）、热导检测器（TCD）、氮磷检测器（NPD）、火焰光度检测器（FPD）、电子捕获检测器（ECD）、质谱检测器（MS）等。示差折光检测器（A错）、荧光检测器（C错）、光二极管阵列检测器（D错）为高效液相色谱仪的检测器。